在急性炎症发生时介导中性粒细胞和血管内皮细胞结合并沿血管壁的移行的是
A. 整合素
B. 免疫球蛋白超家族
C. E-选择素
D. 钙黏蛋白
E. 黏蛋白样血管地址素

正确答案：C。E-选择素

解析：E-选择素在急性炎症发生时介导中性粒细胞和血管内皮细胞结合并沿血管壁的移行。掌握“白细胞分化抗原及黏附分子”知识点。